根据《药品经营质量管理规范》，药品零售企业对拆零药品应
A. 质量审核
B. 专柜存放
C. 质量复核
D. 抽样检验
E. 抽样送检

正确答案：B。专柜存放

解析：本题考查的是药品零售企业药品陈列要求。根据《药品经营质量管理规范》，药品零售企业对拆零药品应专柜存放（B对）。根据《药品经营质量管理规范》，药品零售企业应当定期对拆零药品进行质量审药品陈列要求：药品的陈列应当符合以下要求：按剂型、用途以及储存要求分类陈列，并设置醒目标志，类别标签字迹清晰、放置准确；药品放置于货架（柜），摆放整齐有序，避免阳光直射；处方药、非处方药分区陈列，并有处方药、非处方药专用标识；处方药不得采用开架自选的方式陈列和销售；外用药与其他药品分开摆放；拆零销售的药品集中存放于拆零专柜或者专区；第二类精神药品、毒性中药品种和罂粟壳不得陈列；冷藏药品放置在冷藏设备中，按规定对温度进行监测和记录，并保证存放温度符合要求；中药饮片柜斗谱的书写应当正名正字；装斗前应当复核（A错），防止错斗、串斗；应当定期清斗（C错），防止饮片生虫、发霉、变质；不同批号的饮片装斗前应当清斗并记录；经营非药品应当设置专区，与药品区域明显隔离，并有醒目标志。